舌下腺分泌的副交感纤维来自
A. 动眼神经
B. 面神经
C. 眼神经
D. 舌下神经
E. 迷走神经

正确答案：B。面神经

解析：舌下腺分泌的副交感纤维来自面神经（B对）。动眼神经（A错）的副交感纤维支配瞳孔括约肌及睫状肌，参与瞳孔对光反射和眼的调节反射。眼神经（C错）仅含躯体感觉纤维，支配部分面部、眼鼻皮肤黏膜感觉。舌下神经（D错）含一般躯体运动纤维，支配舌内肌和大部分舌外肌。迷走神经（E错）的一般内脏运动纤维支配胸腹腔脏器的平滑肌、心肌和腺体的活动。